下列穴位归经，错误的是
A. 太白一肝经
B. 列缺一肺经
C. 合谷一大肠经
D. 阳陵泉一胆经
E. 阴陵泉一脾经

正确答案：A。太白一肝经

解析：该题考查穴位归经。太白为脾经穴位（C错，为本题正确答案）。